高血浆蛋白结合率药物的特点是
A. 吸收快
B. 代谢快
C. 排泄快
D. 组织内药物浓度高
E. 与高血浆蛋白结合率的药物合用易出现毒性反应

正确答案：E。与高血浆蛋白结合率的药物合用易出现毒性反应

解析：本题考查高血浆蛋白结合率药物的特点。高血浆蛋白结合率药物的特点是与高血浆蛋白结合率的药物合用易出现毒性反应（E对）。当同时应用一种或多种药物时，它们有可能在血浆蛋白结合部位发生竞争，结果将使某一药物从蛋白结合部位被置换出来变成游离型，在剂量不变的情况下，加大了该药的毒性。结合型药物不能通过血脑屏障，因此会降低高血浆蛋白结合率药物的吸收速率（A错）。结合型药物不能跨膜转运，不能被代谢（B错）或排泄（C错），仅暂时储存在血液中。蛋白结合率高的药物在体内消除较慢，作用维持时间较长。只有游离型药物才能起药物作用，而高血浆蛋白结合率的药物为结合型药物，其在组织内的药物浓度低（D错）。